在营养学中，矿物质是指
A. 金属元素+宏量元素
B. 宏量元素+微量元素
C. 微量元素+金属元素
D. 宏量元素
E. 金属元素

正确答案：B。宏量元素+微量元素